男，44岁。胃癌根治术后第6天，出现上腹剧烈疼痛，逐渐加重，伴恶心、呕吐、腹胀。查体腹膜刺激征（+），腹腔引流管引流出咖啡色浑浊液体。腹部B超提示腹腔积液。针对上述情况，应采取的治疗措施中不包括的是
A. 肠外营养支持
B. 吗啡止痛
C. 应用生长抑素
D. 禁食
E. 胃肠减压

正确答案：B。吗啡止痛

解析：青年男性患者，胃癌根治术后6天出现上腹剧烈疼痛、恶心、呕吐、腹胀，腹膜刺激征阳性，腹腔引流引出咖啡色样浑浊液体，应诊断为吻合口瘘。吗啡止痛（B错，为本题正确答案）会掩盖疼痛，妨碍诊断，并且吗啡可增加平滑肌张力，加重吻合口瘘。生长抑素（C对）抑制胃酸、胃蛋白酶、胰蛋白酶的分泌，减轻患者的症状。发生吻合口瘘后，应立即禁食（D对），以免食物继续进入腹腔而加重病情，同时放置胃管进行胃肠减压（E对），抽出胃肠道内容物和气体，以减少消化道内容物继续流入腹腔。患者禁食、胃肠减压后，能量和营养物质等摄入不足，需行肠外营养等支持治疗，以维持机体基本生命活动所需（A对）。